关于肝脏，下列哪项叙述是错的
A. 其上面与膈肌相贴，故肝脓肿可穿破膈肌进入胸腔
B. 第一肝门位于肝脏脏面的横沟处
C. 第一肝门处有肝管与肝动、静脉
D. 脏面的右纵沟前部是胆囊窝
E. 脏面的左纵沟前部是肝圆韧带

正确答案：C。第一肝门处有肝管与肝动、静脉

解析：肝脏上与膈相贴，肝脓肿可通过膈进入胸腔(A对)，并侵入右肺，第一肝门位于肝脏面中部的横沟(B对)，第一肝门处有肝管、肝固有动脉、肝门静脉及神经、淋巴管，无肝静脉(C错，为本题正确答案)，肝静脉为第二肝门结构，脏面右纵沟前部为胆囊窝(D对)，容纳胆囊，左纵沟前部为肝圆韧带裂，容纳肝圆韧带(E对)。